在公共场所的基本卫生要求中，不包括
A. 合理选址，设计
B. 良好空气质量，适宜小气候
C. 良好的环境
D. 各种设施清洁卫生
E. 废弃物的处理

正确答案：E。废弃物的处理

解析：本题考查公共场所的基本卫生要求。公共场所是根据公众生活活动和社会活动的需要，人工建成的具有多种服务功能的公共建筑设施，供公众进行学习、工作、休息、文体、娱乐、参观、旅游、交流、交际、购物、美容等活动之用。其基本卫生要求包括：1.选址、设计（A对）和装修要求；2.良好的环境（C对）；3.良好的微小气候；4.良好的空气质量（B对）；5.公共用品用具清洁卫生，各种卫生设施运转正常（D对）；6.从业人员必须身体健康并具备基本卫生知识。废弃物的处理（E错，为本题正确答案）不属于公共场所的基本卫生要求。